“热因热用”属于
A. 阴病治阳
B. 阳中求阴
C. 阴中求阳
D. 逆治法
E. 反治法

正确答案：E。反治法

解析：反治指顺从病证的外在假象而治的一种治疗原则。由于采用的方药性质与病证中假象的性质相同，故又称为“从治”。热因热用即以热治热，是指用热性药物来治疗具有假热征象的病证，属于反治（E对）。阴病治阳适用于阳虚阴盛的虚寒证（A错）。阴中求阳和阳中求阴的治法主要用于阴阳互济（BC错）。逆治法即正治，是指采用与疾病的证候性质相反的方药以治疗的一种治疗原则（D错）。